不属于阵发性室上性心动过速临床特点是
A. 突发突止
B. 心率＞150次/分
C. 心律绝对规则
D. 第一心音强弱不等
E. 大部分由折返机制引起

正确答案：D。第一心音强弱不等

解析：第一心音强弱不等（D错，为本题正确答案）是心房颤动的常见体征。阵发性室上性心动过速简称室上速，大部分室上速由折返机制引起（E对），起始突然，通常由一个房性期前收缩触发，其下传的PR间期显著延长，随之引起心动过速发作。临床表现为心动过速发作突然起始与终止（A对），持续时间长短不一，体检心尖区示第一心音强度恒定，心律绝对规则（C对），其心电图表现为心率150～250次/分（B对），节律规则。